关于蛋白质a-螺旋的叙述，错误的是
A. 链内氢键稳定其结构
B. 有些侧链R基团不利于α-螺旋的形成
C. 是二级结构的形式之一
D. 一般蛋白质分子结构中都含有α-螺旋
E. 链内疏水作用稳定其结构

正确答案：E。链内疏水作用稳定其结构